肉芽组织的组成是
A. 毛细血管和弹性纤维
B. 小动脉和纤维母细胞
C. 毛细血管和胶原纤维
D. 纤维母细胞和小细胞
E. 毛细血管和纤维母细胞

正确答案：E。毛细血管和纤维母细胞

解析：肉芽组织的主要成分为新生毛细血管和纤维母细胞（成纤维细胞）（E对）。弹力纤维（A错）和胶原纤维（C错）均可见于疏松结缔组织中，前者排列散乱，略成黄色，富于弹性；后者排列成束，具有韧性，一般比前者略粗。小动脉（B错）为外周阻力血管，小静脉（D错）为容量血管。胶原纤维、小动脉和小静脉的出现均标志着肉芽组织成熟（P37），并逐渐转化为瘢痕组织。